1岁以内婴儿总能量每日每公斤体重约需
A. 80kCal
B. 90kCal
C. 100kCal
D. 110kCal
E. 120kCal

正确答案：C。100kCal

解析：<6月龄婴儿能量平均需要量为90kcal(376.56kJ）/(kg·d），7～12月龄为80kcal(334.72kJ）/(kg·d），但八版儿科学数据中，婴儿能量需要约为100kcal/（kg·d）（C对）。所以本题依照原来的数据选择C，但根据第九版儿科学，需要牢记<6月龄婴儿能量平均需要量为90kcal(376.56kJ）/(kg·d），7～12月龄为80kcal(334.72kJ）/(kg·d）。